糖原分解途径中的关键酶是
A. 果糖二磷酸酶-1
B. 6-磷酸果糖激酶-1
C. HMG-CoA还原酶
D. 磷酸化酶
E. HMG-CoA合成酶

正确答案：D。磷酸化酶